在下述各项中，不符合有利原则的是
A. 医务人员的行动与解除病人的疾苦有关
B. 医务人员的行动使病人受益而可能给别的病人带来损害
C. 医务人员的行动使病人受益而会给家庭带来一定的经济负担
D. 医务人员的行动可能解除病人的痛苦
E. 受病人或家庭条件的限制，医务人员选择的诊治手段不是最佳的

正确答案：B。医务人员的行动使病人受益而可能给别的病人带来损害